特殊类型上感疱疹性咽峡炎的病原菌为
A. 合胞病毒
B. 流感病毒
C. 柯萨奇A组病毒
D. 腺病毒3型
E. 鼻病毒

正确答案：C。柯萨奇A组病毒

解析：本题为记忆题。特殊类型上感疱疹性咽峡炎由柯萨奇A组病毒引起（C对）。合胞病毒（RSV，又称称呼吸道合胞病毒，也属副粘病毒科）（A错）是引起小儿病毒性肺炎最常见的病原，可引起间质性肺炎，及毛细支气管炎。流感病毒（B错），又称流行性感冒病毒，是一种造成人、狗、马、猪及禽类等患流行性感冒的RNA病毒，在分类学上，流感病毒属于正黏液病毒科，它会造成急性上呼吸道感染。腺病毒3型（D错）是引起婴幼儿病毒性肺炎流行的主要病原之一（另一个是腺病毒7型），较大年龄组儿童或青年人感染腺病毒仅引起上呼吸道疾病，在婴幼儿中可引起严重的急性腺病毒性肺炎。鼻病毒（E错）感染，在成人主要引起普通感冒等上呼吸道感染;在婴幼儿和慢性呼吸道疾病患者，除上呼吸道感染外，还能引起支气管炎和支气管肺炎。